肝脏面左纵沟的前部容纳
A. 肝镰状韧带
B. 肝圆韧带
C. 静脉韧带
D. 胆囊
E. 无

正确答案：B。肝圆韧带

解析：肝镰状韧带(A错)位于肝的膈面，而肝圆韧带(B对)位于肝脏面左纵沟的前部，静脉韧带(C错)位于左纵沟的后部，而胆囊(D错)位于右纵沟的前部。